浅反射不包括
A. 角膜反射
B. 腹壁反射
C. 跟腱反射
D. 提睾反射
E. 跖反射

正确答案：C。跟腱反射

解析：跟腱反射属于深反射。常用的浅反射有角膜反射（A对）、咽反射、腹壁反射（B对）、提睾反射（D对）、跖反射（E对）、肛门反射。其传入神经起自体表感受器，经周围神经感觉纤维传入脊髓，与前角细胞发生突触，再经周围神经的运动纤维终于肌肉（C错，为本题正确答案）。